下列哪项属行针基本手法
A. 捻转法，震颤法
B. 提插法，弹针法
C. 震颤法，弹针法
D. 提插法，刮柄法.
E. 提插法，捻转法

正确答案：E。提插法，捻转法

解析：该题考查行针手法。要注意区别行针手法的基本手法和辅助手法。行针的基本手法只包括两种：提插法、捻转法（E对）；辅助手法是行针手法的补充，是以促使得气和加强针刺感应为目的的操作手法。常用的行针辅助手法包括循法、弹法、刮法、摇法飞法、震颤法（ABCD错）。